酮体是指
A. 草酰乙酸，β-羟丁酸，丙酮
B. 乙酰乙酸，β-羟丁酸，丙酮酸
C. 乙酰乙酸，β-氨基丁酸，丙酮酸
D. 乙酰乙酸，γ-羟丁酸，丙酮
E. 乙酰乙酸，β-羟丁酸，丙酮

正确答案：E。乙酰乙酸，β-羟丁酸，丙酮

解析：酮体是指乙酰乙酸，β-羟丁酸，丙酮（E对）。